患者，男，60岁。久患胁痛，悠悠不休，遇劳加重，头晕目眩，口干咽燥，舌红少苔，脉弦细。治疗应首选
A. 柴胡疏肝散
B. .逍遥散
C. 杞菊地黄丸
D. 一贯煎
E. 二阴煎

正确答案：D。一贯煎

解析：患者久患胁痛可诊断为胁痛。患者久病，体虚精血亏损，不能濡养肝络故悠悠不休，遇劳加重；阴虚易生，内热故口干咽燥；精血亏虚，不能上荣故头晕目眩；舌脉均为阴虚症象故为肝络失养证，治宜养阴柔肝，代表方为一贯煎（D对）。肝郁气滞证用柴胡疏肝散或逍遥散（AB错）。杞菊地黄丸合羚角钩藤汤用于关格的肝肾阴虚，虚风内动证（C错）。二阴煎合琥珀养心丹用于狂证 火盛伤阴（E错）。